患者，女，78岁。因患高血压病长期口服硝苯地平控释片（规格为30mg·hg·hg），后续又出现头晕、恶心、心悸、胸闷，随后就医。关于导致患者出现血压明显下降及心悸等症状的原因的说法正确的是
A. 药品质量缺陷所致
B. 由于控释片破碎使较大量的硝苯地平突释
C. 部分缓释片破碎使硝苯地平剂量损失，血药浓度未达有效范围
D. 药品正常使用情况下发生的不良反应
E. 患者未在时辰药理学范畴正确使用的药物

正确答案：B。由于控释片破碎使较大量的硝苯地平突释

解析：本题考查临床中使用缓释、控释制剂的注意事项。导致患者出现血压明显下降及心悸等症状的原因是由于控释片破碎使较大量的硝苯地平突释（B对）。部分缓控释制剂的药物释放速度和释放部位是由制剂表面或夹层的包衣膜控制，如膜控型，定位型释放片，只有保持膜的完整性才能使药物按设定的速度和部位释放达到缓控释目的，如将表面膜破坏后，造成药物从断口瞬时释放，既达不到控释的目的，还会增加不良反应。该患者自行加服一片，并且碾碎后吞服（D错），药物在断口瞬时释放，使药物的血药浓度过高，从而导致血压明显下降，增加了不良反应。硝苯地平控释片利用渗透泵原理控释药物，使药物在体内保持稳定血药浓度，降低应用普通制剂时，导致的血药浓度峰、谷现象，在确保疗效的同时，降低了药物的不良反应。A选项所述原因题干并未涉及（A错）。该患者的血压明显下降说明体内的血药浓度是过高的（C错）。时辰因素指机体内生物节律变化对药物作用的影响，在一天中的任何时间擅自加服碾碎的药片与其无关（E错）。